矽肺胸片中，大阴影的病理基础是
A. 小结节
B. 间质纤维化
C. 团块状纤维化
D. 大结节

正确答案：C。团块状纤维化

解析：本题考查大阴影的概念。大阴影指长径超过10㎜的阴影，为晚期矽肺的重要X线表现，形状有长条形、圆形、椭圆形或不规则形。病理基础是团块状纤维化（C对ABD错）。大阴影周围一般有肺气肿带的X线表现。